B细胞不具备的受体
A. E受体
B. 有丝分裂素受体
C. C3b受体
D. Fc受体
E. TCR

正确答案：E。TCR

解析：TCR为T细胞上的特异性标志，而不是B细胞所具备的受体。掌握“B淋巴细胞”知识点。